不参与维持肾正常位置的是
A. 腹内压
B. 肾的被膜
C. 肾血管
D. 肾周邻近器官
E. 输尿管

正确答案：E。输尿管

解析：输尿管起自肾盂末端，不与肾直接相连，所以不参与维持肾正常位置（E错，为本题正确答案）。